关于生物等效性研究的说法，正确的有
A. 生物等效性研究方法的优先顺序常为药物动力学研究、药效动力学研究、临床研究和体外研究
B. 用于评价生物等效性的药动学指标包括Cmax和AUC
C. 仿制药生物等效性试验应尽可能选择原研产品作为参比制剂
D. 对于口服常释制剂，通常需进行空腹和餐后生物等效性研究
E. 筛选受试者时的排除标准应主要考虑药效

正确答案：A、B、C、D。生物等效性研究方法的优先顺序常为药物动力学研究、药效动力学研究、临床研究和体外研究；用于评价生物等效性的药动学指标包括Cmax和AUC；仿制药生物等效性试验应尽可能选择原研产品作为参比制剂；对于口服常释制剂，通常需进行空腹和餐后生物等效性研究

解析：本题考查生物等效性研究。生物等效性研究方法的优先顺序为药代动力学研究、药效动力学研究、临床研究和体外研究（A对）；用于评价生物等效性的药动学指标包括Cmax、Tmax和AUC（B对）；仿制药生物等效性试验应尽可能选择原研产品作为参比制剂（C对）；对于口服常释制剂，通常需进行空腹和餐后生物等效性研究（D对）；筛选受试者时的排除标准应主要基于安全性方面的考虑（E错）。